关于结核性淋巴结炎的叙述，错误的是
A. 常见于儿童及青年，轻者仅有淋巴结肿大而无全身症状
B. 可同时有肺、肾、肠、骨等器官的结核病变或病史
C. 淋巴结中心因有干酪样坏死，组织溶解变软，逐渐液化破溃
D. 皮肤表面明显的红、热及压痛，扪之有波动感
E. 可发生于双侧

正确答案：D。皮肤表面明显的红、热及压痛，扪之有波动感

解析：结核性淋巴结炎炎症波及周围组织时，淋巴结可彼此粘连成团，或与皮肤粘连。皮肤表面无红、热及明显压痛，扪之有波动感。此种液化现象称为冷脓肿。掌握“面颈部淋巴结炎”知识点。